痰火郁结之痰核瘰疬，宜用
A. 石决明
B. 牡蛎
C. 龙骨
D. 珍珠
E. 代赭石

正确答案：B。牡蛎

解析：牡蛎咸，微寒；入肝、胆、肾经。可潜阳补阴，重镇安神，软坚散结，收敛固涩，制酸止痛。味咸，能软坚散结，治疗痰火郁结之痰核瘰疬（B对）；入肝经，有与石决明类似的平肝潜阳之功，并能益阴，多用治水不涵木，阴虚阳亢，眩晕耳鸣之证；质重能镇，有重镇安神之功；煅后有与煅龙骨相似的收敛固涩作用，可用于多种滑脱不禁之证，可制酸止痛，用治胃痛泛酸。